不正确的是
A. 位于心壁表面,由特殊分化的心肌纤维构成
B. 窦房结位于上腔静脉与右心房交界处的心外膜深面
C. 窦房结为心节律正常起搏点
D. 房室结也可产生冲动
E. 房室束又称His束

正确答案：A。位于心壁表面,由特殊分化的心肌纤维构成

解析：心传导系由特殊心肌细胞（A错，为本题正确答案）构成。窦房结位于上腔静脉与右心房交界处的心外膜深面（B对）。窦房结是心的正常起搏点（C对）。房室结也可产生冲动（D对）而且是最重要的次级起搏点。房室束又称His束（E对）起自房室结前端。